根据《互联网药品信息服务管理办法》，在互联网发布公告的审批部门是
A. 国家食品药品监督管理局
B. 省级药品监督管理部门
C. 工业和信息化部
D. 省级电信管理部门
E. 省级新闻出版管理部门

正确答案：B。省级药品监督管理部门

解析：本题考查药品服务网站开办资格证书的申请与审批程序。根据《互联网药品信息服务管理办法》，在互联网发布公告的审批部门是省级药品监督管理部门（B对）。药品服务网站开办资格证书的申请与审批程序：申请提供互联网药品信息服务，应当填写国家药品监督管理部门统一制发的《互联网药品信息服务申请表》，向网站主办单位所在地省级药品监督管理部门提出申请并提交相应材料，材料包括：①企业营业执照复印件。②网站域名注册的相关证书或者证明文件。从事互联网药品信息服务网站的中文名称，除与主办单位名称相同的以外，不得以“中国”“中华”“全国”等冠名；除取得药品招标代理机构资格证书的单位开办的互联网站外，其他提供互联网药品信息服务的网站名称中不得出现“电子商务”“药品招商”“药品招标”等内容。③网站栏目设置说明（申请经营性互联网药品信息服务的网站需提供收费栏目及收费方式的说明）。④网站对历史发布信息进行备份和查阅的相关管理制度及执行情况说明。⑤药品监督管理部门在线浏览网站上所有栏目、内容的方法及操作说明。⑥药品及医疗器械相关专业技术人员学历证明或者其专业技术资格证书复印件、网站负责人身份证复印件及简历。⑦健全的网络与信息安全保障措施，包括网站安全保障措施、信息安全保密管理制度、用户信息安全管理制度。⑧保证药品信息来源合法、真实、安全的管理措施、情况说明及相关证明。省（区、市）药品监督管理部门在收到申请材料之日起5日内做出受理与否的决定，自受理之日起20日内对申请提供互联网药品信息服务的材料进行审核，并作出同意或者不同意的决定；符合条件的，由省（区、市）药品监督管理部门核发《互联网药品信息服务资格证书》，同时报国家药品监督管理局备案并发布公告。《互联网药品信息服务资格证书》的格式由国家药品监督管理部门统一制定。